NK细胞具有
A. 对TI-Ag应答
B. ADCC
C. 对TD-Ag应答
D. 分泌细胞因子的作用
E. 特异性杀伤作用

正确答案：B。ADCC